某地区有部分儿童出现智力低下，而其他方面发育正常，应重点考虑
A. 汞中毒
B. 铅中毒
C. 砷中毒
D. 碘缺乏病
E. 氟中毒

正确答案：D。碘缺乏病

解析：本题考查碘缺乏病。碘缺乏病是指从胚胎发育至成人期由于碘摄入量不足而引起的一系列病症，包括地方性甲状腺肿、地方性克汀病、地方性亚临床克汀病、流产、早产、死产等。智力低下是地方性克汀病的主要症状，因此某地区有部分儿童出现智力低下，而其他方面发育正常，应重点考虑碘缺乏病（D对ABCE错）。